既可阻断多巴胺D₂受体活性，又能抑制乙酰胆碱酣酶活性的药物是
A. 伊托必利
B. 甲氧氯普胺
C. 多潘立酮
D. 莫沙必利
E. 曲美布汀

正确答案：A。伊托必利

解析：本题考查促胃肠动力药。常用促胃肠动力药大多以多巴胺受体或5-羟色胺受体（5-HT₄）作用靶点，伊托必利（A对）既可阻断多巴胺D₂受体活性，又能抑制乙酰胆碱酯酶活性。